根据《艾滋病防治条例》规定，下列不属于艾滋病病毒感染者或者艾滋病病人应当履行的义务是
A. 接受疾病预防控制机构或者出入境检验机构的流行病学调查和指导
B. 将感染或者发病的事实告知与其有性关系者
C. 就医时，将感染或者发病的事实如实告知接诊医师
D. 医师应对感染者病人的隐私予以保密
E. 采取必要的防护措施，防止感染他人

正确答案：D。医师应对感染者病人的隐私予以保密

解析：本题考查艾滋病的预防与控制、治疗与法律责任。医师应对感染者病人的隐私予以保密（D错，为本题正确答案）不属于艾滋病病毒感染者或者艾滋病病人应当履行的义务。为了保护社会和其他公民的健康权益，艾滋病病毒感染者和艾滋病病人应当履行下列义务：①接受疾病预防控制机构或者出入境检验检疫机构的流行病学调查和指导（A对）；②将感染或者发病的事实及时告知与其有性关系者（B对）；③就医时，将感染或者发病的事实如实告知接诊医生（C对）；④采取必要的防护措施，防止感染他人（E对）。艾滋病病毒感染者和艾滋病病人不得以任何方式故意传播艾滋病。